患者，男，18岁。恶寒发热，头痛身痛，无汗而喘，舌苔薄白，脉浮紧。治疗应首选
A. 小青龙汤
B. 桂枝汤
C. 九味羌活汤
D. 麻黄汤
E. 大青龙汤

正确答案：D。麻黄汤

解析：患者恶寒发热，头痛身痛，无汗而喘，舌苔薄白，脉浮紧。为外感风寒，肺气失宣所致。方用麻黄汤。麻黄开腠发汗、祛在表之风邪，宣肺平喘；桂枝解肌发表，温通经脉；杏仁宣肺平喘；炙甘草调和诸药（D对）。小青龙汤主治外感风寒，寒饮内停之证（A错）。桂枝汤证为外感风寒，营卫不和所致。为治疗外感风寒表虚证的基础方。又是调和营卫、调和阴阳治法的代表方（B错）。九味羌活汤由外感风寒湿邪，兼有蕴热所致。为治疗外感风寒湿邪而兼有里热证的常用方（C错）。大青龙汤由外感风寒兼有郁热所致（E错）。记忆：麻黄汤中用桂枝，杏仁甘草四般施，恶寒发热头身痛，无汗而喘服之宜。